当前化妆品经营中的主要卫生问题是
A. 微生物污染
B. 无卫生许可证产品的销售
C. 化妆品的产品质量
D. 化妆品的无证经营
E. 化妆品的假冒伪劣产品

正确答案：B。无卫生许可证产品的销售

解析：本题考查当前化妆品经营中的主要卫生问题。卫生监督部门必须切实加强对化妆品经营单位的卫生监督。当前化妆品经营中的主要卫生问题是无卫生许可证产品的销售（B对ACDE错）。